不能用于曲霉菌感染的抗真菌药是
A. 氟康唑
B. 卡泊芬净
C. 伏立康唑
D. 两性霉素B
E. 伊曲康唑

正确答案：A。氟康唑

解析：本题考查侵袭性真菌病的药物治疗原则。氟康唑（A错，为本题正确答案）适用于侵袭性念珠菌病（对近期未用过唑类抗真菌药且临床情况稳定的念珠菌（光滑和克柔念珠菌除外）感染，首选氟康唑）、隐球菌病、球孢子菌病，不能用于曲霉菌感染。曲霉菌治疗：伏立康唑（C对）为首选，也可考虑两性霉素B（D对）（若考虑药物存在毒副作用或肾损害时可选择脂质体两性霉素B）治疗。若患者对两性霉素B耐药或不能耐受，卡泊芬净（B对）可供选择，联合使用伏立康唑和卡泊芬净是值得推荐的治疗方法。伊曲康唑（E对）可在病情不十分严重且疑似真菌感染的情况下早期经验性使用。